白细胞介素-2的药理作用特点是
A. 活化巨噬细胞
B. 减少抗体分泌
C. 抑制淋巴细胞DNA的生成
D. 转移免疫信息
E. 调节B细胞和T细胞分化增殖

正确答案：E。调节B细胞和T细胞分化增殖